在体内去甲基代谢反应，且其代谢物有活性的5-羟色胺重摄取抑制剂药物有
A. 氟西汀
B. 盐酸阿米替林
C. 西酞普兰
D. 文拉法辛
E. 舍曲林

正确答案：A、C、D、E。氟西汀；西酞普兰；文拉法辛；舍曲林

解析：本题考查5-羟色胺重摄取抑制剂的代谢。氟西汀（A对）、西酞普兰（C对）、文拉法辛（D对）及舍曲林（E对）在体内去甲基代谢后，其代谢产物有活性。